下列食物中，刺激胆汁分泌和排出作用最强的是
A. 高脂肪食物
B. 高蛋白食物
C. 高盐食物
D. 糖类食物
E. 混合性食物

正确答案：B。高蛋白食物